支气管哮喘与心源性哮喘一时难以鉴别时，先选用
A. 速尿
B. 吗啡
C. 杜冷丁
D. 氨茶碱
E. 肾上腺素

正确答案：D。氨茶碱

解析：氨茶碱（D对）为常用的支气管扩张药，对气道平滑肌有直接松弛作用，当支气管哮喘与心源性哮喘一时难以鉴别时，可选择茶碱类药物，改善气道通气不足等气道综合征。呋塞米又称为速尿（A错），属于强效利尿药，临床可用于严重水肿、急性肺水肿和脑水肿、急慢性肾功能衰竭、加速毒物排泄、纠正高钾血症和高血钙症。心源性哮喘是因急性左心衰竭，引起的肺水肿而导致的呼吸困难、气促和窒息感，静脉注射吗啡（B错）产生镇静作用，消除病人的紧张和恐惧情绪，抑制呼吸中枢对CO₂敏感性，使呼吸由浅快变得深慢，同时还可降低外周阻力，减轻心脏前后负荷，有利于肺水肿的消除。杜冷丁（C错）又称为哌替啶，属于人工合成的阿片受体激动剂，临床可替代吗啡用于心源性哮喘的辅助治疗。肾上腺素（E错）可激动支气管平滑肌的β₂受体而使支气管平滑肌舒张，同时还可抑制肥大细胞释放组胺和其他过敏介质，临床可用于支气管哮喘，但由于本品不良反应严重，仅用于急性发作者。